通过抑制α-葡萄糖苷酶，减少葡萄糖吸收的药物是
A. 吡格列酮
B. 格列本脲
C. 二甲双胍
D. 阿卡波糖
E. 罗格列酮

正确答案：D。阿卡波糖

解析：本题考查阿卡波糖。阿卡波糖（D对）为葡萄糖苷酶抑制剂，通过竞争性抑制α-葡萄糖苷酶，从而减缓淀粉等碳水化合物的分解，延缓葡萄糖的吸收。格列本脲（B错）能够促进胰岛素的释放，降低血清糖原水平。二甲双胍（C错）为双胍类降血糖药，临床主要用于轻症糖尿病患者。罗格列酮（E错）和吡格列酮（A错）为噻唑烷二酮类胰岛素增敏剂，其作用机制与特异性激活过氧化物酶增殖因子激活的γ型受体（PPAR-γ）有关，可提高组织对胰岛素的敏感性，提高组织摄取和利用葡萄糖从而降低血糖。